患者一侧后牙食物嵌塞，嵌塞后引起剧烈疼痛，持续数秒，要求治疗。查：6°龋（是牙合面龋），探敏，叩（-），冷测敏感，不持续，热测同对照牙。该牙诊断应为
A. 中龋
B. 深龋
C. 牙髓充血
D. 慢性牙髓炎
E. 牙本质敏感症

正确答案：B。深龋

解析：本题考查深龋的诊断标准。深龋表现为食物嵌入龋洞中引起疼痛，探诊敏感，冷热刺激进入龋洞引起疼痛，刺激去除后症状立即消失（B对）。中龋患者对酸甜饮食以及冷热刺激表现为酸痛，有的患者无症状，温度测验同正常对照牙（A错）。牙髓充血表现为对冷刺激为一过性敏感，探诊不敏感（C错）。慢性牙髓炎有自发痛史及冷热刺激痛史，患者对有轻微的叩痛或不适（D错）。牙本质敏感对探诊等机械刺激和酸甜刺激更敏感（E错）。